抑制胃液分泌的物质是
A. 促胃液素
B. 组胺
C. 乙酰胆碱
D. 胆盐
E. 盐酸

正确答案：E。盐酸

解析：抑制胃液分泌的主要因素：（1）盐酸（E对）：消化期在食物入胃后可刺激HCl分泌。当HCl分泌过多时，可负反馈抑制胃酸分泌。（2）脂肪：脂肪消化期当食物中的脂肪及消化产物进入小肠后，可刺激小肠粘膜分泌多种胃肠激素，这些激素具有抑制胃液分泌和胃运动作用。（3）高张溶液可通过肠-胃反射抑制胃液分泌。促进胃液分泌的主要因素：（1）迷走神经中有传出神经纤维直接到达胃黏膜泌酸腺中的壁细胞，通过末梢释放ACh（C错）而引起胃酸分泌。（2）组胺（B错）具有极强的促胃酸分泌作用。（3）促胃液素（A错）可强烈刺激壁细胞分泌胃酸。胆盐（D错）有中和胃酸的作用，可促进胃酸的分泌。